膳食调查的方法不包括
A. 生化检查法
B. 称重法
C. 记账法
D. 询问法
E. 化学分析法

正确答案：A。生化检查法